下列属于严重药品不良反应的是
A. 因正常使用药品导致显著的器官功能损伤
B. 因正常使用药品导致住院或者住院时间延长
C. 因正常使用药品导致死亡
D. 因正常使用药品致癌、致畸、致出生缺陷

正确答案：A、B、C、D。因正常使用药品导致显著的器官功能损伤；因正常使用药品导致住院或者住院时间延长；因正常使用药品导致死亡；因正常使用药品致癌、致畸、致出生缺陷

解析：本题考查药品不良反应的分类。属于严重药品不良反应的有：因正常使用药品导致显著的器官功能损伤（A对）；因正常使用药品导致住院或者住院时间延长（B对）；因正常使用药品导致死亡（C对）；因正常使用药品致癌、致畸、致出生缺陷（D对）。严重药品不良反应是指因使用药品引起以下损害情形之一的反应：①导致死亡；②危及生命；③致癌、致畸、致出生缺陷；④导致显著的或者永久的人体伤残或者器官功能的损伤；⑤导致住院或者住院时间延长。